使细菌具有侵袭力的结构成份是
A. 芽胞
B. 肽聚糖（粘肽）
C. 荚膜
D. 核糖体
E. 异染颗粒

正确答案：C。荚膜

解析：细菌的侵袭力是指致病菌突破宿主皮肤、粘膜等生理屏障，进入机体并在体内定植和繁殖扩散的能力，与侵袭力有关的物质主要有粘附素、荚膜（C对）、侵袭素、侵袭性酶类和细菌生物被膜等，其中荚膜具有抗宿主吞噬细胞和抵抗体液中杀菌物质的作用，使致病菌能在宿主体内存在、繁殖和扩散。芽胞（A错）是革兰阳性菌的休眠形式，在不良环境中产生，对热力、干燥、辐射、化学消毒剂等理化因素均有强大的抵抗力，但不直接引起疾病，无侵袭力（P20）。肽聚糖（B错）是一类复杂的多聚体，细菌细胞壁的主要组分，保证细菌结构的完整性，无侵袭力（P11）。核糖体（D错）是细菌合成蛋白质的场所，而与侵袭力无关（P16）。异染颗粒（E错）是白喉棒状杆菌的生物学特性，主要成分是核糖核酸和多偏磷酸盐，对鉴定细菌具有重要意义，而无侵袭力（P164）。